可引起马的脑白质软化的镰刀菌毒素是
A. T-2毒素
B. 赭曲霉毒素
C. 伏马菌素
D. 玉米赤霉烯酮
E. 脱氧雪腐镰刀菌烯醇

正确答案：C。伏马菌素

解析：本题考查可引起马的脑白质软化的镰刀菌毒素。伏马菌素（C对ABDE错）主要的危害是神经毒性作用，可引起马的脑白质软化。